药物的体内过程包括
A. 吸收
B. 激动受体
C. 分布
D. 代谢
E. 排泄

正确答案：A、C、D、E。吸收；分布；代谢；排泄

解析：本题考查药物的体内过程。药物的体内过程包括吸收（A对）、分布（C对）、代谢（D对）、排泄（E对），而激动受体（B错）包含在代谢过程中。